下列哪项不是呼吸性酸中毒合并代谢性酸中毒的病因？
A. 低氧血症
B. 心跳呼吸骤停
C. 严重低钾血症
D. 颅脑损伤
E. 慢性阻塞性肺疾患

正确答案：A。低氧血症

解析：低氧血症（A错，为本题正确答案）的患者可因缺氧刺激呼吸运动增强，CO2排出增多，引起呼吸性碱中毒。呼吸性酸中毒合并代谢性酸中毒常见于严重的通气障碍引起呼吸性酸中毒，同时因持续缺氧而发生代谢性酸中毒。心跳呼吸骤停（B对），严重低钾血症（C对）导致呼吸肌麻痹，颅脑损伤（D对）机制呼吸中枢，慢性阻塞性肺疾患（E对）导致肺通气功能障碍都能导致通气障碍而引起呼吸性酸中毒，继而发生代谢性酸中毒。